痛风急性期禁用的药物是
A. 秋水仙碱
B. 别嘌醇
C. 布洛芬
D. 舒林酸
E. 泼尼松

正确答案：B。别嘌醇

解析：本题考查别嘌醇。痛风急性期禁用的药物是别嘌醇（B对）。别嘌醇不能控制痛风性关节炎的急性炎症症状，不能作为抗炎药使用。因为本品促使尿酸结晶重新溶解时可再次诱发并加重关节炎急性期症状。痛风急性期治疗药物的选择：1.秋水仙碱（A错）。2.非甾体抗炎药：如布洛芬（C错），舒林酸（D错）等。3.糖皮质激素：如泼尼松（E错）等。